关于牙本质渗透性的说法，下列正确的是
A. 细菌产物可以减小牙本质的渗透性
B. 细菌毒素进入牙本质小管不会引起炎症反应
C. 牙本质液的形成增加了细菌入侵的机会
D. 修复性材料可缩小牙本质小管管径，减小其渗透性
E. 氢氧化钙可以增加其渗透性

正确答案：D。修复性材料可缩小牙本质小管管径，减小其渗透性

解析：细菌产物如内毒素可进入牙本质小管并引起炎症反应。此时牙髓血管的渗透性增加，增加的牙髓内压及牙本质内液有利于小管的清洁，并阻止细菌进入牙髓。由于硬化或修复性材料所致的牙本质小管管径缩小，也减少牙本质的渗透性。某些修复材料（洞底）如草酸钾和氢氧化钙，可减少被切割的牙本质小管的渗透性。垫底材料也可能封闭牙本质小管。掌握“牙本质”知识点。